孕妇尿中与胎儿胎盘单位功能关系密切的激素是
A. 雌二醇
B. 雌三醇
C. 雌酮
D. 孕酮
E. 睾酮

正确答案：B。雌三醇

解析：雌激素于妊娠10周后主要由胎儿-胎盘单位合成，可反映胎儿胎盘功能。雌激素包括雌二醇、雌酮和雌三醇。至妊娠末期，雌三醇值为非孕妇女的1000倍；雌二醇（A错）及雌酮（C错）值为非孕妇女的100倍（P34）；孕酮（D错）值孕期与孕前没有大的倍数差异；妊娠期间睾酮（E错）浓度很低，可见与胎儿胎盘功能关系最密切的激素是雌三醇（B对）。